下列能参与大腿后伸的肌是
A. 股四头肌
B. 长收肌
C. 大收肌
D. 梨状肌
E. 臀大肌

正确答案：E。臀大肌

解析：股四头肌（A错）屈髋关节和伸膝关节。长收肌（B错）和大收肌（C错）使髋关节内收和旋外。梨状肌（D错）使髋关节外展和旋外。臀大肌（E对）使髋关节后伸和旋外。